戴全口义齿出现咬颊现象，需磨改
A. 上后牙舌尖舌斜面和下后牙舌尖颊斜面
B. 上后牙舌尖颊斜面和下后牙舌尖舌斜面
C. 上后牙颊尖颊斜面和下后牙颊尖颊斜面
D. 上后牙颊尖舌斜面和下后牙颊尖颊斜面
E. 上后牙颊尖舌斜面和下后牙舌尖颊斜面

正确答案：D。上后牙颊尖舌斜面和下后牙颊尖颊斜面

解析：本题考查戴用义齿初期易出现的问题及处理-咬颊、咬舌。戴全口义齿出现咬颊现象通常是由于后牙排列覆盖过小，因此可适当磨改上后牙颊尖舌斜面和下后牙颊尖颊斜面（D对）。若出现咬舌现象，可适当磨改上后牙舌尖舌斜面和下后牙舌尖颊斜面（A错）。